用于粘接暂时修复体的是
A. 磷酸锌水门汀
B. 氧化锌丁香油水门汀
C. 树脂水门汀
D. 玻璃离子水门汀
E. 聚羧酸锌水门汀

正确答案：B。氧化锌丁香油水门汀

解析：本题考查暂时修复体的试戴与粘固。用于粘接暂时修复体的是氧化锌丁香油水门汀（B对）。暂时粘固水门汀一般为氧化锌丁香酚水门汀，它有良好的安抚、镇痛、封闭作用。但由于丁香酚可以阻碍树脂的聚合，对于今后将采用树脂类粘接剂粘固或粘接的情况，在暂时粘固时须选择不含丁香酚的暂时粘固水门汀。目前，很多用于暂时粘固的水门汀均由两组分膏剂（基质和催化剂）组成；使用时通过适当比例混合，操作非常简便；同时它还具有易就位、易凝固、易清理等优点。